胃的静脉回流，下列哪项叙述是错误的
A. 胃左静脉汇入门静脉或脾静脉
B. 胃短静脉汇入膈下静脉
C. 胃右静脉汇入门静脉主干
D. 胃网膜左静脉汇入脾静脉
E. 胃右静脉接受幽门前静脉血

正确答案：B。胃短静脉汇入膈下静脉

解析：胃左静脉汇入门静脉或脾静脉（A对）。胃短静脉汇入门静脉（B错，为正确答案）。胃右静脉汇入门静脉主干（C对）。胃右静脉接受幽门前静脉血（E对）。